乳牙患龋的易感因素
A. 牙釉质、牙本质薄
B. 矿化度低，抗酸力弱
C. 儿童食品多为软质、粘性、高糖
D. 儿童自洁和清洁能力差
E. 以上都是

正确答案：E。以上都是

解析：本题考查乳牙患龋的易感因素。乳牙较恒牙易患龋，这与乳牙的形态解剖特点、组织结构特点、矿化程度及其所处环境等因素有关。乳牙的矿化度低，抗酸力弱（B对）、牙釉质牙本质薄（A对），较恒牙更易引起组织破坏，加速龋病进展。且儿童食品多为软质、黏性、高糖（C对），这类食物致龋力强且易附于牙面，容易导致乳牙龋病发生。加之儿童自洁和清洁能力差（D对），难以自觉维护口腔卫生，成为致龋的重要因素。（ABCD均对，故E为本题的正确答案）。